医学模式是指
A. 临床医学、预防医学和康复医学
B. 内科、外科、妇科和儿科
C. 人对健康的基本观点和对策
D. 祖国传统医学和西方现代医学
E. 内科和外科的综合模式

正确答案：C。人对健康的基本观点和对策

解析：本题考查医学模式。医学模式是指人对健康的基本观点和对策（C对），是医学临床和医学科研的指导思想、理论框架和行为范式。